静止期杀菌药是
A. 头孢菌素
B. 氯霉素
C. 磺胺嘧啶
D. 异烟肼
E. 庆大霉素

正确答案：E。庆大霉素

解析：本题考查静止期杀菌药。庆大霉素（E对）为氨基糖苷类抗菌药物，该类药物可抑制细菌蛋白质合成的全过程，为静止期杀菌药。头孢菌素（A错）类对处于繁殖期正大量合成细胞壁的细菌作用强，属于繁殖期杀菌剂。氯霉素（B错）为酰胺醇类抗菌药物，主要为抑菌剂。磺胺嘧啶（C错）为磺胺类抗菌药，主要通过干扰叶酸代谢而发挥抗菌作用。异烟肼（D错）为抗结核分枝杆菌药物，选择性抗结核分枝杆菌而对其它微生物几乎无作用。